上皮根鞘连续性遭到破坏可形成
A. 福代斯斑
B. 牙源性囊肿
C. 上皮剩余
D. 侧支根管
E. 牙颈部牙本质敏感症

正确答案：D。侧支根管

解析：本题考查上皮根鞘。上皮根鞘连续性遭到破坏可形成侧支根管（D对）。上皮根鞘对于牙根的正常发育是很重要的。（1）上皮根鞘的连续性受到破坏，或在根分叉处上皮隔的舌侧突起融合不全，则不能诱导分化出成牙本质细胞，而引起该处牙本质缺损，牙髓和牙周膜直接通连，这时形成侧支根管。（2）如果上皮根鞘上皮在规定时间没有发生断裂，仍附着在根部牙本质的表面，则牙囊的间充质细胞不能与该处牙本质接触，也就不能分化出成牙骨质细胞形成牙骨质。这样在牙根表面特别在牙颈部，牙本质暴露，引起牙颈部过敏（E错）。（3）上皮根鞘残留在牙周膜中称为上皮剩余（C错）。